药品上市前要经过临床评价阶段有
A. Ⅰ期临床试验
B. Ⅱ期临床试验
C. Ⅲ期临床试验
D. Ⅳ期临床试验
E. Ⅴ期临床试验

正确答案：A、B、C。Ⅰ期临床试验；Ⅱ期临床试验；Ⅲ期临床试验

解析：本题考查新药临床评价。Ⅰ期临床试验（A对）、Ⅱ期临床试验（B对）、Ⅲ期临床试验（C对）属于药品上市前的临床评价阶段。Ⅳ期临床试验（D错）是药品上市后药品临床再评价阶段。没有Ⅴ期临床试验（E错）。